具有特异性杀伤作用的细胞是
A. B细胞
B. 中性粒细胞
C. NK细胞
D. CTL细胞
E. LAK细胞

正确答案：D。CTL细胞